气不内守，大量向外丢失的病理状态是
A. 气虚
B. 气滞
C. 气逆
D. 气闭
E. 气脱

正确答案：E。气脱

解析：气脱指气不内守，大量向外脱失，以致机体功能突然衰竭的病机变化（E对）；气虚指一身之气不足，而表现出相应功能减退的病机变化（A错）；气滞指气的运行不畅，郁滞不通的病机变化（B错）；气逆指气升之太过，或降之不及，以脏腑之气逆上为特征的病机变化（C错）；气闭指气闭阻于内，不能外出，以致清窍闭塞，出现昏厥的病机变化（D错）。